女，33岁。现左乳房包块10天，无不适症状。查体：乳房视诊无异常，左乳房外上象限可触及1.5cm×1.5cm包块，质硬，活动度良好，左腋窝未触及肿大淋巴结。钼靶X线片检查示1.5cm×lcm密度增高影，周边有小毛刺，中央可见聚集细小钙化点。术后10天拟行综合治疗，决定是否可用靶向治疗（曲妥珠单抗）的肿瘤标记物是
A. ER
B. Her-2
C. P53
D. Ki67
E. PR

正确答案：B。Her-2

解析：对于人表皮生长因子受体2（Her-2）（B对）基因过表达的乳腺癌患者，给予曲妥珠单抗进行靶向治疗有一定的效果。雌激素受体/ER（A错）、孕激素受体/PR（E错）是决定是否进行内分泌治疗的指标。ER含量高者对内分泌治疗有效；ER含量低者对内分泌治疗欠佳。P53（C错）是突变的抑癌基因，P53阳性提示肿瘤预后不佳，P53阴性提示肿瘤预后较好。Ki67（D错）提示细胞的增殖活跃程度，其阳性率越高，肿瘤细胞增殖活性越强，预后越差。